女，71岁。2型糖尿病史10年。查体：BP140/95mmHg，心率65次/分。实验室检查：血Cr160μmol/L，血K⁺4.2mmol/L，尿蛋白（+）。该患者降血压药应首选
A. 钙通道阻滞剂
B. 利尿剂
C. 血管紧张素Ⅱ受体阻滞剂
D. α受体阻滞剂
E. β受体阻滞剂

正确答案：C。血管紧张素Ⅱ受体阻滞剂

解析：患者老年女性，有2型糖尿病病史，BP140/95mmHg（正常值90～139/60～89mmHg，提示轻度高血压），血Cr160μmol/L（正常值44～133μmol/L），血K⁺4.2mmol/L（正常值3.5～5.5mmol/L），尿蛋白（+），患者考虑诊断为糖尿病合并高血压。该患者降血压药应多选用血管紧张素转换酶抑制剂（ACEI）或血管紧张素Ⅱ受体阻滞剂（ARB）（C对）。ARB降压作用主要通过阻滞组织ATⅡ受体亚型AT1，更充分有效地阻断ATⅡ的血管收缩、水钠潴留与重构作用；和ACEI一样，具有改善胰岛素抵抗和减少尿蛋白作用。故ACEI和ARB都特别适合于糖尿病合并高血压患者。要注意的是，一般常把ACEI作为糖尿病合并高血压患者的首选用药，本题答案中无ACEI选项，因此可选择血管紧张素Ⅱ受体阻滞剂作为该患者的首选用药。钙通道阻滞剂（P255）（A错）对血脂、血糖等无明显影响，可用于高血压合并糖尿病患者，但并非首选用药。利尿剂（B错）可使血脂、血糖、血尿酸升高，β受体阻滞剂（P253）（E错）能增加胰岛素抵抗，还可能掩盖和延长低血糖反应，两者都不适合用于糖尿病伴高血压患者。用于抗高血压治疗的α受体阻滞剂（D错）主要为α₁受体阻滞剂，如哌唑嗪、特拉唑嗪等，因其副作用较多，目前不主张单独使用。